硬腭后缘鼻后棘的表面解剖标志是
A. 腭凹
B. 腭垂
C. 腭舌弓
D. 腭咽弓
E. 腭大孔

正确答案：A。腭凹

解析：腭凹：在软腭前端中线两侧的黏膜凹陷，是硬腭后缘鼻后棘的表面解剖标志。掌握“腭、舌、舌下区的局部解剖”知识点。